高钾血症对心肌生理特性的影响是
A. 兴奋性升高，传导性升高，自律升高，收缩性升高
B. 兴奋性升高，传导性下降，自律升高，收缩性升高
C. 兴奋性先升高后下降，传导性下降，自律下降，收缩性下降
D. 兴奋性下降，传导性升高，自律下降，收缩性下降
E. 兴奋性下降，传导性升高，自律下降，收缩性升高

正确答案：C。兴奋性先升高后下降，传导性下降，自律下降，收缩性下降

解析：急性轻度高钾血症时由于细胞外液钾浓度增高，静息期细胞内钾外流减少，使Em绝对值减少，与Et间距离缩短而兴奋性增高。急性重度高钾血症时因Em值过小，肌肉细胞膜上的快钠通道失活，细胞处于去极化阻滞状态而不能兴奋（C对）。心肌细胞膜对K⁺的通透性增高，复极化4期K⁺外流加快，而Na⁺内流相对减速，心肌自律性降低（AB错）。心肌细胞膜Em绝对值减少，去极化时Na⁺内流速度减慢，故动作电位0期去极化速度减慢和幅度降低，兴奋的扩布因而减慢，心肌传导性降低（DE错）。K⁺对Ca2⁺内流的抑制作用增强，因而复极化2期时Ca2⁺内流减少，心肌收缩性减弱。